以下哪项不属于雌激素替代治疗的适应证
A. 骨质疏松
B. 围绝经期综合征
C. 绝经后期
D. 血栓性疾病
E. 老年性阴道炎

正确答案：D。血栓性疾病

解析：雌激素替代治疗不能够治疗血栓性疾病（D错，为本题正确答案）。它能促进骨中钙的沉积，可以治疗骨质疏松（A对）。围绝经期综合征常被称为更年期综合征，是指女性绝经前后这段时期因性激素波动或减少所致的一系列躯体及精神心理症状所以雌激素可以治疗（BC对）。老年性阴道炎多因女性卵巢功能衰退，雌激素水平减少，阴道萎缩、弹性降低、抵抗病菌入侵能力下降而引起的炎症（E对）。